检测病毒并进行微生物学检查时，不是标本采集原则是
A. 无菌操作
B. 发病早期采集
C. 采集病变部位标本
D. 查抗体时，采早期血清即可
E. 尽快送检，暂将标本低温冷藏

正确答案：D。查抗体时，采早期血清即可

解析：病毒感染实验室检查的成败关键，在于标本的正确采集和递送。发病初期或急性期采集的标本，易于分离出病毒。应根据不同的病毒感染，采集不同类型的标本。病毒在室温中很容易灭活，故标本采集后应立即送往病毒实验室，否则应将标本低温冷藏。掌握“病毒感染检查方法及防治原则”知识点。